根据待分离物质的吸附能力不同，用于分离提纯的方法是
A. 重结晶法
B. 硅胶柱色谱法
C. 分馏法
D. 升华法
E. 凝胶色谱法

正确答案：B。硅胶柱色谱法

解析：本题考查的是中药化学成分的分离与精制。根据待分离物质的吸附能力不同，用于分离提纯的方法是硅胶柱色谱法（B对）。硅胶吸附色谱法和氧化铝吸附色谱法可以用于柱色谱吸附分离和薄层色谱分离。无论柱色谱还是薄层色谱分离，硅胶、氧化铝都为分离载体，也叫吸附剂，分离原理都是根据吸附能力大小不同进行分离。从不纯的结晶经过进一步加溶剂结晶进行精制处理得到较纯结晶的过程称为重结晶（A错）。分馏法（C错）是根据物质的沸点进行分离。通常利用中药中各成分沸点的差别进行分离。升华法（D错）固体物质在受热时不经过熔融直接转化为气体状态，该气体遇冷后又凝结成固体的现象称为升华。凝胶色谱法（E错）也称凝胶过滤法、凝胶渗透色谱、分子筛过滤或排阻色谱，是根据物质分子大小差别进行分离。